小儿感冒夹痰的病机是
A. 肺脏娇嫩
B. 先天不足
C. 乳食积滞
D. 脾胃湿困
E. 肾气不足

正确答案：A。肺脏娇嫩

解析：小儿肺脏娇嫩，感邪之后，失于宣肃，气机不利，津液不得敷布而内生痰液，痰壅气道，则咳嗽加剧，喉间痰鸣，此为感冒夹痰，故小儿感冒夹痰的病机是肺脏娇嫩（A对）先天不足与小儿感冒夹痰无直接联系（B错）。乳食积滞可见于小儿感冒夹滞（C错）。脾胃湿困不常见小儿，小儿与成人生理特点有区别，小儿脾常不足，易因饮食不节或喂养失当致脾胃病，不是小儿感冒夹痰的病机（D错）。肾气不足与小儿感冒夹痰无关（E错）。